小儿4个月，人工喂养，平时易惊，多汗，睡眠少，近2日来咳嗽低热，今晨突然双眼凝视，手足抽动。查体：枕后有乒乓球感。止抽后的处理是
A. 静滴钙剂
B. 供给氧气
C. 肌注呋塞米（速尿）
D. 肌注维生素B2
E. 静滴葡萄糖液

正确答案：A。静滴钙剂

解析：4个月患儿有枕后乒乓球感、双眼凝视、手足抽动的临床变现，可诊断为维生素D缺乏性手足搐搦症。维生素D缺乏性手足搐搦症是由于维生素D缺乏，使钙的吸收障碍，从而导致血清钙降低，所以维生素D缺乏性手足搐搦症的止抽后的处理是静滴钙剂（A对）。供给氧气是抽搐发生时的急救措施，而不是抽后的处理措施（B错）。肌注呋塞米一般用与水肿的治疗，属于无关干扰项（C错）。抽搐后续的处理应该是给予维生素D进行治疗而不是肌注维生素B2（D错）。静滴葡萄糖液用于低糖血症的治疗，对维生素D缺乏性手足搐搦症的治疗帮助不大（E错）。